Turesky改良的Q-H菌斑指数记分为5的是
A. 牙颈部龈缘处有散在的点状菌斑
B. 牙颈部菌斑覆盖宽度超过1mm，但在牙面1/3以下
C. 牙颈部菌斑宽度不超过1mm
D. 菌斑覆盖面积占牙面2/3以上
E. 牙面无菌斑

正确答案：D。菌斑覆盖面积占牙面2/3以上

解析：5＝菌斑覆盖面积占牙面2/3以上。掌握“牙周病流行病学及分级预防”知识点。